调制箍围药，取其清凉解毒作用的，应选用
A. 醋
B. 葱
C. 鸡子清
D. 麻油
E. 丝瓜叶汁

正确答案：E。丝瓜叶汁

解析：箍围药是借药粉和液体调制成的糊剂，具有箍集围聚、收束疮毒的作用，从而促使肿疡消散、疮形缩小、早日成脓破溃、消肿截毒。箍围药的调制液体多种多样，临床应根据疾病的性质与阶段不同，正确选择使用。以菊花汁、丝瓜叶汁、金银花露调者可清凉解毒，其中用丝瓜叶汁调制的玉露散治疗暑天疖肿效果较好（E对）；以醋（A错）调者可散瘀解毒；以酒调者可助行药力；以葱（B错）、姜、韭、蒜捣汁调者可辛香散邪；以鸡蛋清（C错）调者可缓和刺激；以油（D错）类调者可润泽肌肤。